患者，男，50岁，高血压病史3年。期间先后用硝苯地平片和硝苯地平控释片控制血压，近日出差曾饮酒和引用多种饮料，出现血压波动情况。该患者下列生活行为中，可能会导致硝苯地平血浆浓度升高的是
A. 饮酒
B. 喝茶
C. 喝咖啡
D. 吸烟
E. 饮用葡萄柚汁

正确答案：E。饮用葡萄柚汁

解析：本题考查饮食对药物疗效的影响。饮用葡萄柚汁（E对）会导致硝苯地平血浆药物浓度升高。葡萄柚汁主要影响 CYP3A4代谢，同时可抑制CYP3A4的活性。硝苯地平通过CYP3A4代谢，与葡萄柚汁同服会引起生物利用度增加。服药期前饮酒（A错）一般会导致药物疗效降低与不良反应增加。茶叶（B错）主要影响药物的吸收。咖啡（C错）因与中枢镇静药、催眠药作用相拮抗。吸烟（D错）会使药物代谢速度加快。